骨骼肌细胞动作电位下降支是由于
A. K⁺内流
B. Cl⁻内流
C. Na⁺内流
D. K⁺外流
E. Ca²⁺内流

正确答案：D。K⁺外流